患儿，2岁。面色苍白，唇淡甲白、发黄稀疏，神疲乏力，形体消痩3个月，诊断为营养性缺铁性贫血。西药选用铁剂治疗后，正确的停药时间为血红蛋白（）
A. 开始升高时
B. 达正常时
C. 达正常后2个月左右
D. 达正常后4个月左右
E. 达正常后6个月左右

正确答案：C。达正常后2个月左右

解析：该患儿已被明确诊断为营养性缺铁性贫血，即由于体内铁缺乏，使血红蛋白合成减少，临床以小细胞低色素性贫血、血清铁蛋白减少和铁剂治疗有效为特点的贫血症。故西医治疗以去除病因和补充铁剂为主。其中，经铁剂治疗血红蛋白达正常水平后，应继续服用铁剂6～8周再停药（约2个月），以补足铁的贮存量（C对）。